医疗机构施行特殊治疗时
A. 可以由经治医生决定施行
B. 可以由本科在科主任主持下讨论决定施行
C. 由医院决定施行
D. 可以征求患者意见
E. 必须征得患者或其家属同意

正确答案：E。必须征得患者或其家属同意